递呈抗原的细胞是
A. NK细胞
B. B细胞
C. 肥大细胞
D. 细胞毒性T淋巴细胞
E. 浆细胞

正确答案：B。B细胞

解析：本题考查递呈抗原的细胞。递呈抗原的细胞是B细胞（B对）。NK细胞（A错）来源于骨髓淋巴样干细胞，其不表达特异性抗原识别受体，而是通过表面活化性受体和抑制性受体对“自身”与“非己”进行识别，并直接杀伤某些肿瘤和病毒感染的靶细胞。肥大细胞（C错）主要分布于呼吸道、胃肠道和泌尿生殖的的黏膜上皮及皮肤下的结缔组织内靠近血管处，参与Ⅰ型超敏反应。细胞毒性T淋巴细胞（CTL）（D错）表达CD8，通常所指的CD8+T细胞即指CTL，主要功能是特异性识别内源性抗原肽-MCHⅠ类分子复合物，进而杀伤靶细胞。浆细胞（E错）又称抗体形成细胞（AFC），能分泌大量特异性抗体，是B细胞的分化的终末细胞。